下列是社区的有
A. 一群人住在一个地域内
B. 一个行政地区
C. 一群人
D. 一个地域
E. 宏观社会的缩影

正确答案：E。宏观社会的缩影

解析：本题考查社区的意义。社区作为一个社会生活实体，是宏观社会系统的“缩影”（E对ABCD错）。